按五行属性分类，五化属土者是
A. 生
B. 长
C. 化
D. 收
E. 藏

正确答案：C。化

解析：按事物属性的五行分类，生（A错）属木，长（B错）属火，化（C对）属土，收（D错）属金，藏（E错）属水。